需要加入抑菌剂的有
A. 低温灭菌的注射剂
B. 滤过除菌的注射剂
C. 无菌操作制备的注射剂
D. 多剂量装的注射剂
E. 静脉给药的注射剂

正确答案：A、B、C、D。低温灭菌的注射剂；滤过除菌的注射剂；无菌操作制备的注射剂；多剂量装的注射剂

解析：本题考查注射剂的灭菌方法。为了防止注射剂在制造和使用过程中被微生物污染，采用低温灭菌（A对）、滤过除菌（B对）或无菌操作法（C对）制备的注射液，以及多剂量的注射液（D对），应加入适宜抑菌剂。用于静脉或脊髓注射的注射液一律不得加抑菌剂。